顺经汤的组成是
A. 当归，生地，白芍，丹皮，栀子，茜草，白茅根
B. 人参，麦冬，山药，半夏，大枣，甘草，丹参
C. 栀子，赤茯苓，当归，黄芩，白芍，生地，泽泻
D. 当归，熟地，沙参，白芍，茯苓，黑荆芥，丹皮
E. 生地，当归，川芎，蒲黄，牛膝，白芍，甘草梢

正确答案：D。当归，熟地，沙参，白芍，茯苓，黑荆芥，丹皮

解析：妇人肾阴不足，肝气上逆，经前一二日，忽然腹痛而吐血，宜用顺经汤。熟地、沙参意在滋补肾阴，白芍，当归，丹皮养血活血柔肝调经，黑荆芥味清香以疏肝解郁，茯苓健脾和中助生化之源。方取补肾清肝之效，故名顺经汤。（D对）。